抗瘤谱较窄，对放疗有增敏作用的药物是
A. 阿霉素
B. 放线菌素D
C. 环磷酰胺
D. 丝裂霉素
E. 紫杉醇

正确答案：B。放线菌素D